与其他类型抗结核药间有交叉耐药性
A. 异烟肼
B. 利福平
C. 两者均有
D. 两者均无

正确答案：D。两者均无